诊断早期糖尿病肾病较有意义的检查是
A. 尿常规检查
B. 尿微量白蛋白测定
C. 尿渗透压测定
D. 双肾B超
E. 肌酐清除率

正确答案：B。尿微量白蛋白测定

解析：糖尿病肾病患者肾小球高灌注、高滤过，尿蛋白可呈阳性，其中以尿微量白蛋白更具代表性，早期糖尿病肾病期，最突出的表现为出现持续微量白蛋白尿，UAER（尿白蛋白排泄率）持续在20～200ug/min（正常＜10ug/min），因此尿微量白蛋白测定用于诊断早期糖尿病肾病（B对）。尿常规检查（A错）仅作为一般检查，多种疾病均可出现异常结果，如原发性与继发性肾病、肾小球肾炎、泌尿系感染、造血系统疾病等，不具有代表性。尿渗透压测定（C错）常用于诊断急性肾功能衰竭，而早期糖尿病肾病期尿渗透压无明显异常。双肾B超检查（D错）可反映肾脏形态变化，慢性肾衰竭时双肾可缩小，早期糖尿病肾病期肾脏一般无异常。肌酐清除率（E错）可代表肾小球滤过率，早期糖尿病肾病期肌酐清除率可高于正常或正常，无法反映肾小球滤过膜受损。